关于产力的描述正确的是
A. 肛提肌收缩力协助胎先露在骨盆腔内进行内旋转
B. 子宫收缩力的特点有节律性、不对称性、极性
C. 产力只包括子宫收缩力、腹壁肌及膈肌收缩力
D. 子宫收缩力只在第一产程起作用
E. 第二产程主要是膈肌收缩力的作用

正确答案：A。肛提肌收缩力协助胎先露在骨盆腔内进行内旋转

解析：产力是将胎儿及其附属物从宫腔内逼出来的力量，包括子宫收缩力、腹壁肌及膈肌收缩力和肛提肌收缩力（C错），其中，子宫收缩力是临产后的主要产力，贯穿于分娩全程（DE错），正常子宫收缩力的特点有节律性、对称性、极性及缩复作用（B错）；而腹壁肌及膈肌收缩力是第二产程胎儿娩出时的重要辅助力量（E错），肛提肌收缩力可协调胎先露部在盆腔进行内旋转（A对）。